遇光极易氧化，使其分子内脱氢，产生吡啶衍生物的药物有
A. 硝苯地平
B. 尼群地平
C. 去甲肾上腺素
D. 肾上腺素
E. 维拉帕米

正确答案：A、B。硝苯地平；尼群地平

解析：本题考查钙通道阻滞剂。硝苯地平（A对）和尼群地平（B对）均为1，4-二氢吡啶类钙通道阻滞剂，该类药物遇光易氧化，产生硝基苯、亚硝基苯吡啶衍生物。去甲肾上腺素（C错）、肾上腺素（D错）、维拉帕米（E错）不是吡啶类药物，不能产生吡啶衍生物。